表示病例组与对照组某因素暴露比例的比值
A. RR
B. AR
C. AR%
D. OR
E. PARP

正确答案：D。OR